属于缓冲区的部位是
A. 切牙乳突区
B. 磨牙后垫区
C. 后堤区
D. 牙槽嵴顶区
E. 颊侧翼缘区

正确答案：A。切牙乳突区

解析：本题考查无牙颌的功能分区。根据无牙颌的组织结构特点和全口义齿的关系，将无牙颌分为四个区，即主承托区、副承托区、边缘封闭区和缓冲区。主承托区的临床意义在于承担义齿的大部分咀嚼压力，副承托区主要辅助主承托区承担小部分的咀嚼压力，缓冲区主要为了在部分区域进行充分缓冲，避免义齿修复后出现黏膜压痛，边缘封闭区与义齿的固位密切相关。切牙乳突区（A对）属于缓冲区。磨牙后垫区（B错）属于边缘封闭区。后堤区（C错）起边缘封闭的作用，属于边缘封闭区。牙槽嵴顶区（D错）属于主承托区。颊侧翼缘区（E错）属于副承托区。